下列关于生物监测的叙述错误的是
A. 有些化学物不能或难以进行生物监测
B. 如果所有人的测得值都在生物监测接触限值以下，可以认为工作环境是符合职业卫生要求的
C. 生物监测结果的解释远比环境监测结果的解释复杂
D. 如果大部分人的测得值都在生物接触限值以下，而少数人测得值远高于生物接触限值，说明一定是少数人的工作岗位，暴露了较高浓度水平的污染物
E. 生物监测不能反映车间空气中化学物瞬间浓度变化的规律

正确答案：D。如果大部分人的测得值都在生物接触限值以下，而少数人测得值远高于生物接触限值，说明一定是少数人的工作岗位，暴露了较高浓度水平的污染物